按照国家卫生标准，牛奶中脂肪的含量要求
A. ≥5%
B. ≤5%
C. ≥3%
D. 3%～5%
E. 2%～3%

正确答案：C。≥3%